在水质易受污染的地点和管网系统陈旧部分设置的每一个采样点，每月采样应不少于
A. 1次
B. 2次
C. 3次
D. 4次
E. 6次

正确答案：B。2次

解析：本题考查水质采样。在水质易受污染的地点和管网系统陈旧部分设置的每一个采样点，每月采样应不少于两次（B对ACDE错）。